人类口腔念珠菌病的主要致病菌是
A. 热带念珠菌
B. 假热带念珠菌
C. 白色念珠菌
D. 克柔念珠菌
E. 近平滑念珠菌

正确答案：C。白色念珠菌

解析：引起人类念珠菌病的主要是白色念珠菌、热带念珠菌和高里念珠菌，占60%～80%。近年来报道，念珠菌感染菌种存在变迁趋势，引起念珠菌感染中非白色念珠菌增多，且在病灶中可存在多种致病性念珠菌的混合感染。掌握“口腔念珠菌病”知识点。